喉上界平面位于
A. 第4颈椎体
B. 第5颈椎体
C. 第6颈椎体
D. 第6胸椎体
E. 第7胸锥体

正确答案：A。第4颈椎体

解析：喉上界平面位于第4颈椎体（A对）。